下列哪项是心包积液所致的心脏浊音界改变情况
A. 心浊音界向左扩大
B. 心浊音界向右扩大
C. 心浊音界向两侧扩大
D. 心浊音界缩小
E. 心浊音界不变

正确答案：C。心浊音界向两侧扩大

解析：心包积液主要由肿瘤、特发性心包炎和肾衰竭造成，其浊音界改变情况为心浊音界向两侧扩大（C对）。心浊音界向左扩大（A错）可见于右侧大量胸腔积液。心浊音界向右扩大（B错）可见于左侧气胸。心浊音界缩小（D错）可见于肺气肿。心浊音界不变（E错）是正常人心脏叩诊的一般表现。